通过作用于脂肪、肌肉、肝脏来增加胰岛素敏感性，增加葡萄糖利用和减少葡萄糖生成的口服降糖药是
A. 恩格列净
B. 吡格列酮
C. 阿格列汀
D. 格列喹酮
E. 米格列醇

正确答案：B。吡格列酮

解析：本题考查吡格列酮的作用机制。吡格列酮（B对）可与1种或多种过氧化物酶体增殖物活化受体（PPAR）结合并使其激活，PPAR通过与配体结合调节基因表达。